《麻醉药品管理办法》规定，贩卖麻醉药品和器粟壳，构成犯罪的
A. 给予行政处罚
B. 给予行政处分
C. 按照治安管理处罚条例处罚
D. 依法追究其刑事责任
E. 向人民法院申请强制执行

正确答案：D。依法追究其刑事责任